女性，23岁。心尖区可闻及收缩中晚期吹风样杂音及喀喇音，超声心动图可见二尖瓣前叶呈吊床样波形，最可能的诊断是
A. 二尖瓣狭窄
B. 二尖瓣关闭不全
C. 主动脉瓣狭窄
D. 主动脉瓣关闭不全
E. 二尖瓣脱垂

正确答案：E。二尖瓣脱垂

解析：二尖瓣脱垂是指二尖瓣叶在心室收缩期脱入左心房（向左房侧膨出），伴或不伴有二尖瓣关闭不全。当瓣叶突然紧张或其索腱的突然拉紧时可产生震动而出现喀喇音；若二尖瓣脱垂造成二尖瓣关闭不全，血液由左室反流至左房，可同时产生收缩中晚期吹风样杂音。超声心动图为诊断二尖瓣脱垂的首选方法，常显示二尖瓣前叶呈吊床样波形。本例患者有典型的二尖瓣脱垂的杂音和超声心动图改变，最可能的诊断是二尖瓣脱垂（E对）。二尖瓣狭窄（A错）的特征性杂音为心尖区舒张中晚期隆隆样杂音，超声心动图示二尖瓣前叶呈“城墙样”改变；二尖瓣关闭不全（B错）的杂音只有心尖区全收缩期杂音；主动脉瓣狭窄（C错）的典型杂音为胸骨右缘第1～2肋间收缩期粗糙而响亮的射流性杂音；主动脉瓣关闭不全（D错）的杂音为主动脉瓣区舒张期叹气样杂音，超声心动图示舒张期二尖瓣前叶快速高频的振动，这四种瓣膜疾病一般都不会出现喀喇音。